关于反复发作脚癣治疗的说法，错误的有
A. 可长期局部使用糖皮质激素
B. 表面症状消失后即可停药
C. 合并糖尿病的患者应特别注意控制血糖
D. 抗真菌药首选伏立康唑
E. 用药期间经常用肥皂清洗患部皮肤

正确答案：A、B、E。可长期局部使用糖皮质激素；表面症状消失后即可停药；用药期间经常用肥皂清洗患部皮肤

解析：本题考查手足真菌感染的药物治疗。避免滥用激素软膏，涂擦激素软膏只能起到一时的缓解（A错，为本题正确答案）。一般治疗体、股癣需2～4周，足癣需1个月，甲癣需3～6个月。使用外用药物症状消失后，真菌仍然存活在皮肤鳞屑或贴身衣物中，遇到潮暖环境又会大量繁殖，导致癣病复发。因此，表面症状消失后，仍要坚持用药1～2周（B错，为本题正确答案）。糖尿病患者或肥胖患者应控制好基础疾病（C对）。伏立康唑临床上主要应用于深部真菌感染，如真菌性角膜炎、口腔念珠菌病以及皮肤真菌感染如体癣、股癣，手、足癣和甲癣（D对）。用药期间，对患部皮肤尽量不洗烫水，少用或不用肥皂和碱性药物（E错，为本题正确答案）。